特发性血小板减少性紫癜血热伤络证的治法是
A. 清热解毒，凉血止血
B. 益气健脾，摄血养血
C. 滋阴清热，凉血宁络
D. 活血化瘀，理气止血
E. 清热解毒，凉血宁络

正确答案：A。清热解毒，凉血止血

解析：特发性血小板减少性紫癜血热伤络证是由于邪热内盛，破血妄行，灼伤脉络，溢于肌表所致，治以清热解毒，凉血止血，方药为犀角地黄汤（A对E错）。益气健脾，摄血养血（B错）为气不摄血证的治法。滋阴清热，凉血宁络（C错）为阴虚火旺证的治法。活血化瘀，理气止血（D错）为气滞血瘀证的治法。